辐照用于食品不能起到的作用是
A. 抑制生芽
B. 延迟后熟
C. 杀菌防腐
D. 防治昆虫
E. 增进色香

正确答案：E。增进色香

解析：本题考查辐照保藏的作用。食品的辐照保藏主要用于食品杀菌（C对）、灭虫（D对）、抑制蔬菜发芽（A对）、延迟果实后熟（B对），以延长食品保藏期。通过辐照保藏无法增进色香（E错，为本题正确答案）。